眼动脉通过
A. 眶上裂
B. 眶下裂
C. 颈静脉孔
D. 破裂孔
E. 视神经管

正确答案：E。视神经管

解析：眼动脉通过视神经管（E对）入眶。